牙周探诊时探诊力量约为
A. 10～15g
B. 15～20g
C. 20～25g
D. 25～30g
E. 30～35g

正确答案：C。20～25g

解析：牙周探诊时探诊力量要轻，约为20～25g。掌握“牙周疾病检查”知识点。